男，52岁。初诊2型糖尿病2个月，每天进主食量约500g，身高171cm。体重90kg，BMI30.8。查空腹血糖5.8mmol/L，餐后2小时血糖12.8mmol/L，糖化血红蛋白7.2%。目前首选的治疗药物是
A. 阿卡波糖
B. 那格列奈
C. 二甲双胍
D. 格列本脲
E. 吡格列酮

正确答案：A。阿卡波糖

解析：中年男性，初诊2型糖尿病，BMI30.8（BMI≥28kg/m²为肥胖），空腹血糖5.5mmol/L（空腹血糖＜6.1mmol/L，为正常血糖），餐后2小时血糖12.8mmol/L（餐后2小时血糖>11.1mmol/L，餐后血糖升高），糖化血红蛋白7.2%（HbA1c≥6.5%，提示糖尿病）。二甲双胍通过激活单磷酸腺苷活化的蛋白激酶 (AMPK) 信号系统而发挥多方面的代谢调节作用（C错）。阿卡波糖（A对）适用于肥胖型餐后高血糖升高者。那格列奈（B错）适用于非肥胖型餐后高血糖。吡格列酮（E错）适用于胰岛素抵抗明显者。格列本脲（P745）（D错）适用于非肥胖型2型糖尿病。